诊断牙槽突骨折最有力的证据是
A. 牙龈撕裂
B. 牙齿松动
C. 牙齿移位，咬合关系紊乱
D. 摇动损伤区的牙时，可见邻近数牙随之移动
E. 局部疼痛，不敢咬合

正确答案：D。摇动损伤区的牙时，可见邻近数牙随之移动

解析：牙槽突骨折常是外力（如碰撞）直接作用于牙槽突所致，多见于上颌前部，可以单独发生，也可与颌面部其他损伤同时发生，可以是线形也可是粉碎性骨折。临床上，牙槽突骨折常伴有唇和牙龈的肿胀、撕裂、牙松动、牙折或牙脱落。摇动损伤区某一牙时，可见邻近数牙及骨折片随之移动。骨折片可移位，引起咬合错乱。掌握“牙槽突骨折、颌骨骨折”知识点。